腹腔干或肠系膜上动脉的直接分支不包括
A. 胃左动脉
B. 胃右动脉
C. 回结肠动脉
D. 中结肠动脉
E. 肝总动脉

正确答案：B。胃右动脉

解析：胃左动脉（A对）、肝总动脉（E对）为腹腔干的直接分支。回结肠动脉（C对）、中结肠动脉（D对）为肠系膜上动脉的直接分支。胃右动脉（B错，为本题正确答案）为胃十二指肠动脉的分支。